消化性溃疡穿孔的早期临床表现中不包括
A. 寒战、高热
B. 恶心、呕吐
C. 有局限性压痛和反跳痛
D. 腹肌紧张
E. 肠鸣音减弱或消失

正确答案：A。寒战、高热

解析：消化性溃疡穿孔的早期表现为突发上腹剧痛，迅速波及全腹，穿孔后酸性的胃内容物流入腹腔，引起化学性腹膜炎（A错，为本题正确答案），穿孔后常伴有恶心呕吐（B对），严重时有血压下降。腹肌紧张呈“板状腹＂（D对），肠鸣音减弱或消失（E对）。患者穿孔后酸性胃内容物立即流入腹腔，所以造成全腹压痛反跳痛(C对），胃十二指肠后壁溃疡穿孔 ，可在局部导致粘连包裹，造成局限性压痛和反跳痛。